用于治疗鼓膜未穿孔的急性中耳炎，外耳道炎的药品是
A. 过氧乙酸溶液
B. 酚甘油滴耳液
C. 高锰酸钾溶液
D. 苯酚溶液
E. 碳酸氢钠滴耳液

正确答案：B。酚甘油滴耳液

解析：本题考查酚甘油滴耳液。酚甘油滴耳液（B对）适应证：用于鼓膜未穿孔的急性中耳炎，外耳道炎的治疗。过氧乙酸溶液（A错）可用于对物体表面、皮肤、黏膜、食具、蔬菜、水果、环境的消毒。高锰酸钾溶液（C错）是一种强氧化剂，可以杀灭细菌，为家庭必备的常用消毒药。苯酚溶液（D错）用于牙髓炎﹑龋齿窝及牙根管消毒。碳酸氢钠滴耳液（E错）用于软化耵聍(耳垢）及冲洗耳道。